高钙血症患者出现低镁血症的机制是
A. 影响食欲而镁摄入降低
B. 镁向细胞内转移
C. 镁吸收障碍
D. 镁随尿排出增多
E. 镁从粪便排出增多

正确答案：D。镁随尿排出增多

解析：当血清蛋白浓度正常时，血钙大于2. 75mmol/L，或血清Ca2＋大于 1. 25mmol/L， 称为高钙血症。血钙浓度升高会减少肾小管对镁的重吸收，镁随尿排出增多（D对）而导致低镁血症。